心脏后前位X线片见心缘弧度消失，呈烧瓶状的是
A. 二尖瓣狭窄
B. 心包积液
C. 心肌病
D. 高血压性心脏病
E. 肺源性心脏病

正确答案：B。心包积液

解析：心包积液的X线表现：积液在300mL以下者，X线可无异常发现。大量积液的X线征象为心影向两侧扩张，呈普遍增大型或球形，心腰及心缘各弓的正常分界消失，心膈角变钝；心缘搏动普遍减弱甚至消失，主动脉搏动可正常；短期内心影大小可有明显的变化（B对）。球形心见于二尖瓣关闭不全（A错）。心肌病心影多呈普遍增大型或主动脉型。各房室均有增大，以左心室增大最为显著（C错）。高血压性心脏病心脏呈靴形（D错）。心脏可失去正常形态，二尖瓣型见于慢性肺源性心脏病（E错）。